生物大分子药物、微粒系统给药的转运方式属于
A. 易化扩散
B. 主动转运
C. 膜孔过滤
D. 膜动转运
E. 简单扩散

正确答案：D。膜动转运

解析：本题考查药物的转运方式。生物大分子在体内的转运方式是膜动转运（D对），细胞通过膜动转运摄取微粒或大分子物质称吞噬，大分子物质从细胞内转运到细胞外称为胞吐。